非细胞型微生物的测量单位是
A. μm
B. nm
C. cm
D. dm
E. m

正确答案：B。nm

解析：非细胞型微生物：非细胞型微生物为形体最小，以纳米（nm）为测量单位，结构最为简单，仅含有一种核酸RNA或DNA，或仅为传染性蛋白粒子，具有超级寄生性，仅在活的易感细胞中才能复制，且易变异的最低等生物体，包括病毒、朊粒等。掌握“微生物定义、分类及特点”知识点。